下列除哪项外均是妊娠禁药
A. 峻下剂
B. 破血剂
C. 逐瘀剂
D. 和血剂
E. 有毒剂

正确答案：D。和血剂

解析：和血剂多用于调补气血，调节体内气血平衡（D对）。妊娠期某些药物具有损害胎元以致堕胎的副作用，所以应该作为妊娠禁忌的药物。根据药物对胎元损害程度不同，一般分为慎用和禁用两大类。禁用药物绝对不能使用，慎用药物除非必要时，一般尽量避免使用。慎用的药物包括通经祛瘀、行气破滞及辛热滑利之品；禁用的药物是指毒性较强或药性猛烈的药物。凡峻下（A错）、滑利、祛瘀（C错）、破血（B错）、耗气、散气以及一切有毒药品（E错），都应该慎用或禁用。